下列哪项不是茯苓的性状特征
A. 呈类球形、椭圆形或不规则块状
B. 外皮棕褐色至黑褐色，粗糙，有明显皱纹
C. 体轻，能浮于水面
D. 断面内部白色，少数淡红色
E. 嚼之粘牙

正确答案：C。体轻，能浮于水面

解析：本题考查的是茯苓药材的性状鉴别。茯苓体重，不能浮于水面（C错，为本题正确答案）。茯苓：【性状鉴别】药材茯苓个呈类球形、椭圆形、扁圆形或不规则团块（A对），大小不一。外皮薄而粗糙，棕褐色至黑褐色，有明显的皱缩纹理（B对）。体重，质坚实，断面颗粒性，有的具裂隙，外层淡棕色，内部白色，少数淡红色（D对），有的中间抱有松根（习称茯神）。气微，味淡，嚼之粘牙（E对）。体轻，能浮于水面为海金沙药材的鉴别特征。海金沙：【性状鉴别】药材呈粉末状，棕黄色或浅棕黄色。体轻，手捻有光滑感，置手中易由指缝滑落。气微，味淡。将海金沙粉末撒在水中则浮于水面，加热始逐渐下沉；将其少量撒于火上，即发出轻微爆鸣及明亮的火焰。